提示支气管哮喘患者病情危重的是
A. 呼气相延长
B. 脉压增加
C. 呼吸性碱中毒
D. 胸腹矛盾运动
E. 烦躁不安

正确答案：D。胸腹矛盾运动

解析：支气管哮喘患者表现为呼气性呼吸困难，危重的支气管哮喘患者用力呼气易导致呼吸肌疲劳，从而出现胸腹矛盾运动（D对）（吸气时，腹壁内陷，与正常相反）。呼气相延长（A错）为支气管哮喘患者发作时的典型临床表现，但并不提示病情危重。支气管哮喘发作时由于过度通气表现为呼吸性碱中毒，但病情危重时就会出现呼吸性酸中毒（C错）。支气管哮喘发作可有奇脉，奇脉表现为吸气时左心搏出量减少，收缩压比呼气时降低，因此脉压减小（B错）。按照哮喘急性发期的分度，轻、中、重度患者常有烦躁不安，但危重患者不能讲话，嗜睡或意识模糊（E错）。